男，40岁。右下肢肿胀、剧痛3小时。1天前用粪便在农田施肥时，右足被扎伤，半夜感胀裂样痛，症状加重，出现下肢肿胀，皮肤由紫红变成黑紫、水肿有水泡。查体：局部皮下有捻发音，伤口处有恶臭的血性浆液渗出。最可能的致病菌是
A. 乙型溶血性链球菌
B. 大肠埃希菌
C. 表皮葡萄球菌
D. 梭状芽胞杆菌
E. 结核杆菌

正确答案：D。梭状芽胞杆菌

解析：患者中年男性，右足扎伤史（坏疽常见感染病史），初始右下肢肿胀、剧痛，随后感胀裂样痛，症状加重，出现下肢肿胀，皮肤由紫红变成黑紫、水肿有水泡（气性坏疽典型症状）。查体：局部皮下有捻发音（气性坏疽体征），伤口处有恶臭的血性浆液渗出（坏疽体征）。根据患者病史和临床表现该患者诊断为气性坏疽。导致气性坏疽的原因是梭状芽胞杆菌（D对）感染。乙型溶血性链球菌（A错）是引起急性弥漫性增生性肾小球肾炎的主要病菌。大肠埃希菌（B错）是肠道中重要的正常菌群，在宿主免疫力下降或细菌侵入肠道外组织器官后，即可成为机会致病菌，引起肠道外感染。表皮葡萄球菌（C错）最常导致早期术后的人工瓣膜感染性心内膜炎。结核杆菌（E错）多导致结核病且以低热为特征。